胃溃疡致瘢痕性幽门梗阻最典型的临床表现是
A. 腹痛
B. 腹胀
C. 贫血
D. 恶病质
E. 呕吐

正确答案：E。呕吐